甲状舌管囊肿临床诊断特点是
A. 生长缓慢，呈圆形
B. 位于颈部正中，可随吞咽及伸舌等动作而移动
C. 质软，周界清楚
D. 与表面皮肤及周围组织无粘连
E. 患者多无症状

正确答案：B。位于颈部正中，可随吞咽及伸舌等动作而移动

解析：本题考查甲状舌管囊肿的临床诊断特点。甲状舌管囊肿临床诊断特点是位于颈部正中，可随吞咽及伸舌等动作而移动（B对）。甲状舌管囊肿生长缓慢，呈圆形（A错）；位于颈部正中，可随吞咽及伸舌等动作而移动，这是其临床诊断特点；质软，周界清楚（C错），与表面皮肤及周围组织无粘连（D错）；患者多无自觉症状（E错）。